晚期胃癌，最常发生转移的远处淋巴结为
A. 颈部
B. 腋窝
C. 腹股沟
D. 左锁骨上
E. 胃窦部小弯处

正确答案：D。左锁骨上